呈慢性复发性头痛的是
A. 椎-基底动脉供血不足
B. 鼻源性头痛
C. 肌收缩性头痛
D. 偏头痛
E. 急性青光眼

正确答案：D。偏头痛

解析：偏头痛是临床最常见的原发性头痛类型，临床以发作性中重度、搏动样头痛为主要表现，头痛多为偏侧，且呈慢性复发性，一般持续4～72小时，可伴有恶心、呕吐，光、声刺激或日常活动均可加重头痛（D对）；椎-基底动脉供血不足临床症状以眩晕最为常见，可伴有头痛、弱视或失明等（A错）；鼻源性头痛是指由鼻腔、鼻窦、鼻咽部病变引起的头痛。鼻部病变可直接刺激鼻黏膜三叉神经末梢引起头痛，并可沿其分支放射至头部相应部位（B错）；肌收缩性头痛主要表现为额头、太阳穴和头后部出现紧箍样疼痛（C错）；急性青光眼常见症状为视力急剧下降、剧烈头痛、眼痛、畏光、流泪等（E错）。